健康体检时，胸部X线片发现肺内靠近胸膜的孤立性小结节，此时应首先进行的检查是
A. 定期复查胸部X线片
B. 支气管镜
C. 痰细胞学
D. 胸部CT
E. 经皮穿刺活检

正确答案：D。胸部CT

解析：胸部X线片发现孤立小结节，位于肺门靠近胸膜，为明确诊断，应首选进行的检查是胸部CT（D对）。定期复查胸部X线片（A错）不能在短期内明确诊断，故不选。支气管镜（B错）、痰细胞学（C错）经皮穿刺活检（E错）均可以用来确诊肺癌，但是均没有胸部CT便捷直观，所以不作为首选。